一哺乳患者，右乳内发现4cm大硬块，疼痛已两天。多为
A. 乳癌
B. 炎性乳癌
C. 急性乳房炎
D. 肉瘤
E. 乳房囊性增生病

正确答案：C。急性乳房炎